疾病发生的条件不正确的说法是
A. 主要是指那些能够影响疾病发生的各种机体内外因素
B. 它们本身不能引起疾病
C. 可以左右病因对机体的影响促进疾病的发生
D. 年龄和性别也可作为某些疾病的发生条件
E. 条件在疾病发生中的作用是固定不变的

正确答案：E。条件在疾病发生中的作用是固定不变的

解析：疾病发生的条件是指能促进或减缓疾病发生的某种机体状态或自然环境或社会因素（A对）；条件本身不引起疾病（B对）；年龄和性别也可作为某些疾病发病的条件（D对）；原因或条件在不同疾病中可独立存在或互相转化（E错，为本题正确答案）。